男性，50岁。咳嗽，咳白色泡沫痰10年，每年持续4个月。近3年出现活动后气短，时有哮端。体检：两肺叩诊高清音，呼吸音低，呼气延长。为明确诊断应选择
A. 动脉血气分析
B. 心电图
C. 痰液检查
D. 呼吸功能测定
E. 血常规

正确答案：D。呼吸功能测定